随着CCl₄染毒剂量的增高GPT显著增高
A. 效应
B. 反应
C. 剂量-效应（反应）关系
D. 有的个体不遵循剂量（效应）反应关系规律

正确答案：C。剂量-效应（反应）关系

解析：本题考查剂量-反应（效应）关系。剂量-反应（效应）关系是指外源化学物作用于生物体的剂量与引起的生物学改变的发生率或作用强度之间的相互关系。通常，随着剂量的增加，外源化学物导致的某种生物学作用的发生率或作用强度也随之增加或减少。可知随着CCl₄染毒剂量的增高GPT显著增高为剂量-反应（效应）关系（C对ABD错）。